关于去甲肾上腺素激动的受体，下列说法正确的是
A. 去甲肾上腺素有强大的激动心脏β受体的作用
B. 去甲肾上腺素能够选择性激动α受体
C. 去甲肾上腺素能够对心脏β1受体作用较弱
D. 去甲肾上腺素对心脏β2作用较强
E. 去甲肾上腺素选择性激动α1受体

正确答案：C。去甲肾上腺素能够对心脏β1受体作用较弱

解析：去甲肾上腺素激动α受体作用强大，对于α1和α2受体无选择性。对心脏β1受体作用较弱，对β2受体几乎没有作用。掌握“去甲肾上腺素”知识点。